2003年8月底至9月初，北京市某工厂员工中爆发一起症状类似流感的不明原因发热呼吸道疾病，经流行病学调查和实验室检测证实是一起由热水淋浴系统的莲蓬喷头污染引起的。该病最有可能是
A. 不良建筑综合征
B. 流行性感冒
C. 与建筑物有关的疾病
D. 庞蒂亚克热
E. 军团菌肺炎

正确答案：D。庞蒂亚克热

解析：本题考查庞蒂亚克热。本题中该病最有可能是庞蒂亚克热（D对ABCE错）。庞蒂亚克热是军团病的一种临床表现类型，是一种发病急且具自限性流感样疾病，潜伏期短，主要症状为发热、寒战、咳嗽、胸痛、头痛、乏力、肌肉痛、食欲缺乏等。有时有胸膜炎及渗出炎症，但无肺炎表现。预后良好，无死亡。